燀白扁豆的炮制作用是
A. 除去非药用部位
B. 改变药物性能
C. 分离不同药用部位
D. 改变药物作用趋向
E. 缓和药物性能

正确答案：C。分离不同药用部位

解析：本题考查的是燀制的主要目的。燀白扁豆的炮制作用是分离不同药用部位（C对）。燀法是将药物置沸水中浸煮短暂时间，取出，分离种皮的方法。燀制的主要目的：①在保存有效成分的前提下，除去非药用部分（A错），如苦杏仁等。②分离不同药用部位，如白扁豆等。改变药物性能（B错）与缓和药物性能（E错）为蒸制的目的。蒸法是将净选或切制后的药物加液体辅料或不加辅料装入蒸制容器内隔水加热至一定程度的方法。蒸制的目的：①改变药物性能，扩大用药范围，如何首乌、地黄等。②增强疗效，如肉苁蓉、山茱萸等。③缓和药性，如大黄、女贞子等。④减少副作用，如大黄、黄精等。⑤保存药效，利于贮存，如黄芩、桑螵蛸等。⑥便于软化切制，如木瓜、天麻等。改变药物作用趋向（D错）为炙法的目的。炙法是将净选或切制后的药物，加入定量的液体辅料拌炒，使辅料逐渐渗入药物组织内部的炮制方法。药物吸入辅料经加热炒制后在性味、功效、作用趋向、归经和理化性质方面均能发生某些变化，起到降低毒性、抑制偏性、增强疗效、矫臭矫味、使有效成分易于溶出等作用，从而达到最大限度地发挥疗效的目的。